测得孕妇坐骨结节间径7cm，出口后矢状径7cm，现妊娠39周，宫口开达2cm，正确的分娩方式是
A. 自然分娩
B. 会阴侧切自然分娩
C. 产钳术
D. 胎头吸引术
E. 剖宫产术

正确答案：E。剖宫产术

解析：该孕妇坐骨结节间径7cm，出口后矢状径7cm，坐骨结节间径与出口后矢状径之和为14cm（＜15cm），诊断为骨盆出口平面狭窄。孕妇现妊娠39周（已满37周），为足月胎儿，不易经阴道分娩，有剖宫产指征，故应行剖宫产术（E对A错）。会阴侧切自然分娩（P181）（B错）的指征是：会阴过紧或胎儿过大，估计分娩时会阴撕裂难以避免者或母儿有病理情况者急需结束分娩者。产钳术（C错）和胎头吸引术（D错）为阴道助产术，适用于胎头已达阴道内但分娩困难的产妇。